苯胺接触工人，尿中（）的含量与血中高铁血红蛋白的量呈平行关系，因此可以以其为检测指标判断工人的苯胺中毒程度
A. 马尿酸
B. 对氨基酚
C. 苯基羟胺
D. 苯醌

正确答案：B。对氨基酚

解析：本题考查苯胺接触者的生化指标。苯胺入血后经氧化先形成毒性更大的中间代谢产物-苯基羟胺（苯胲），然后再氧化生成对氨基酚，与硫酸、葡萄糖醛酸结合后，经尿排出。随苯胺吸收量的增加，其代谢物对氨基酚也相应增加，故暴露苯胺者，尿液中对氨基酚（B对ACD错）含量常与血液中高铁血红蛋白的含量呈平行关系，对氨基酚量可用来判断苯胺接触工人的中毒程度。